水肿的病机是
A. 阴阳平衡失调
B. 血液循行迟缓
C. 血液运行停滞
D. 津液输布排泄障碍
E. 津液亏虚不能润养

正确答案：D。津液输布排泄障碍

解析：本题考查的是津液失调。水肿的病机是津液输布排泄障碍（D对）。津液失调，是指津液代谢障碍所产生的津液不足和输布排泄障碍的病机变化。1.津液不足：津液不足，是指津液在数量上的亏少，进而导致内则脏腑，外而孔窍、皮毛，失其濡润滋养（E错）作用，因之产生一系列干燥失润的病机变化。多由燥热之邪或五志之火，或发热、多汗、吐泻、多尿、失血，或过用误用辛燥之剂等引起津液耗伤所致。常见口、鼻、皮肤干燥，大吐、大泻、多尿时所出现的目陷、螺瘪，甚则转筋等；热病后期或久病伤阴，所见到的舌光红无苔或少苔、唇舌干燥而不引饮、形瘦肉脱、肌肤毛发枯槁，甚则肌肉、手足震颤蠕动等临床表现。2.津液的输布、排泄障碍：津液的输布障碍，是指津液得不到正常的输布，导致津液在体内环流迟缓，或在体内某一局部发生滞留，因而津液不化，水湿内生，酿痰成饮。津液的排泄障碍主要是指津液转化为汗液和尿液的功能减退，而致水液潴留，上下溢于肌肤而为水肿。导致津液输布排泄障碍的原因很多，主要涉及肺的宣发和肃降、脾的运化和散精、肝的疏泄条达、肾的蒸腾气化和三焦的水道是否通利。应当指出，津液的输布障碍和排泄障碍，二者虽然有别，但亦常相互影响和互为因果，其结果导致内生水湿，酿痰成饮，引起多种病变。阴阳平衡失调（A错）为疾病发生、发展和变化的根本原因。血液循行迟缓（B错）可导致血瘀。血瘀，是指血液的循行迟缓和不流畅的病机变化。血液运行停滞（C错）即瘀血。瘀血，是指体内局部血液的停滞，包括离经之血积存体内，或血运不畅，阻滞于经脉、脏腑及其他部位的血液，均称为瘀血。